女性，病毒性咽炎后甲状腺肿大，发热，触痛，吞咽时疼痛加重，可放射至耳部，甲状腺质地较硬，结节可推动。该如何进行治疗
A. 糖皮质激素
B. 头孢呋辛
C. 甲巯咪唑
D. 布洛芬
E. 放射性碘

正确答案：D。布洛芬

解析：病毒性咽炎后甲状腺肿大，发热，触痛，吞咽时疼痛加重，可放射至耳部，甲状腺质地较硬，结节可推动可以诊断为亚急性甲状腺炎，治疗仅需要应用非甾体抗炎药（D对）。